男，5岁。高热1天，第2天出疹，全身皮肤弥漫性充血发红，可见密集均匀的红色细小丘疹，面部潮红，唇周苍白，咽扁桃体充水肿，舌乳头红肿突起。最可能的诊断是
A. 风疹
B. 麻疹
C. 幼儿急疹
D. 猩红热
E. 水痘

正确答案：D。猩红热

解析：猩红热为乙型溶血性链球菌所致，高热、皮肤弥漫充血，上有密集针尖大小皮疹，发热1-2天出疹，出疹时高热、咽峡炎、草莓舌均为其特征性表现（D对）。风疹（A错）全身症状轻，高热少见；麻疹（B错）虽会发热出疹但无杨梅舌典型表现；幼儿急疹（C错）表现为热退疹出；水痘（E错）多为低热，发热第二天出疹，且皮疹由最初的红色斑疹和丘疹变成透明饱满的水泡。